人体实验中科学对照原则的重要性不包括
A. 正确判定实验结果的客观性
B. 减少对受试者肉体的冲击
C. 符合实验者心理要求
D. 符合医学科学研究的需要
E. 减少对受试者心理和人格的冲击

正确答案：C。符合实验者心理要求

解析：符合实验者心理要求不是科学对照原则的重要性（C错，为本题正确答案）。安慰剂对照以削弱受试者的知情同意为前提的，其目的是为了保证研究及其结果客观可靠（A对）。技术性风险包括身体的、心理的、社会的和经济的伤害，对技术性风险的评估可以在定性和定量两方面进行（B对）。人体试验的目标是以提高诊断、治疗和预防技术水平为目标，以达到了解疾病的病因与发病机制，从而更好地维护与增进人类健康，促进医学发展。因此，人体试验不仅是必然、必要的，而且也可以得到伦理的辩护和支持（D对）。尊重受试者自我决定权，这是对受试者人格完整性的尊重（E对）。